皮下注射破伤风抗病毒（TAT）被动免疫的有效期是
A. 14天
B. 5天
C. 7天
D. 终生
E. 10天

正确答案：E。10天

解析：本题考查破伤风。皮下注射破伤风抗病毒（TAT）被动免疫的有效期是10天（E对）。破伤风抗毒素的被动免疫有效期为10日左右。被动免疫法对伤前未接受自动免疫的伤员，尽早皮下注射破伤风抗毒素（TAT）1500～3000IU。破伤风的发病有潜伏期，尽早注射有预防作用，但其作用短暂，有效期为10日左右。因此，对深部创伤可能感染厌氧菌的病人，可在1周后追加注射一次量。抗毒素易发生过敏反应，注射前必须进行皮内敏感试验。如过敏，应按脱敏法注射。目前最佳的被动免疫是肌内注射250～500IU人体破伤风免疫球蛋白（TIG）。人体破伤风免疫球蛋白是自人体血浆免疫球蛋白中提纯或用基因重组技术制备的,，一次注射后在人体可存留4～5周，免疫效能10倍于破伤风抗毒素。